有关牙槽突骨折说法错误的是
A. 常伴有牙损伤
B. 好发于颌骨前部
C. 以曲面体层片最常用
D. 为低密度线条状影像
E. X线片上骨折线为不规则

正确答案：C。以曲面体层片最常用

解析：本题考查牙槽突骨折。有关牙槽突骨折说法错误的是以曲面体层片最常用（C错，为本题正确答案）。牙槽突骨折多发生于颌骨前部，以根尖片和牙合片最为常用。在X线片上骨折线为不规则、不整齐的低密度线条状影像，呈横形、斜形或纵形，常伴有牙损伤。